医生在治疗过程中，把病人当作自己的患病的亲人，悉心照料。该医生出现以上行为属于
A. 移情
B. 反移情
C. 同情
D. 亲情
E. 爱情

正确答案：B。反移情

解析：反移情是医师把对生活中某个重要人物的情感、态度和属性转移到了来访者身上（B对）。移情（A错）指的是患者无意识地将个人关系中的亲密关系和情感投射到医师身上，